应激时急性期蛋白不具有下列哪一种功能？
A. 抑制蛋白酶
B. 清除异物和坏死组织
C. 抗感染，抗损伤
D. 抑制纤溶
E. 清除自由基

正确答案：D。抑制纤溶

解析：应激时急性期蛋白具有抑制蛋白酶（A对）、清除异物和坏死组织（B对）、.抗感染，抗损伤（C对）、清除自由基（E对）和促进纤溶（D错，为本题正确答案）的功能。